早期妊娠的诊断，下列哪项最为准确
A. 停经伴恶心、呕吐
B. 阴道充血变软，呈紫蓝色
C. 子宫增大
D. B超探及胎心管搏动
E. 自觉胎动

正确答案：D。B超探及胎心管搏动